血白细胞增多，异型淋巴细胞比例常高于10%，多见于
A. 伤寒
B. 中毒型菌痢
C. 流行性乙型脑炎
D. 急性病毒性肝炎
E. 流行性出血热

正确答案：E。流行性出血热

解析：流行性出血热实验室检查白细胞总数增高，可见异型淋巴细胞，血小板减少（E对）；尿蛋白进行性增加，有膜状物，出现红细胞和管型；血尿素氮增高。伤寒实验室检查细胞计数常为（3～5）×10⁹/L，中性粒细胞减少，嗜酸性粒细胞减少甚至消失；血小板计数可降低，合并DIC或溶血性尿毒综合征时可突然下降（A错）。中毒型菌痢作肛拭子或生理盐水灌肠镜检，可见大量白细胞或脓细胞（B错）。流行性乙型脑炎血象白细胞总数增高，常为（10～20）×10⁹/L，中性粒细胞比例80%上，部分患者血象始终正常（C错）。